哪项不是描述疾病流行强度的术语
A. 暴发
B. 散发
C. 流行
D. 大流行
E. 季节性

正确答案：E。季节性